无论体内、体外环境，以下具有强大的抗凝作用的药物是
A. 肝素
B. 香豆素
C. 阿司匹林
D. 他汀类
E. 氯甲双胍

正确答案：A。肝素

解析：肝素在体内、体外肝素均有强大抗凝作用，可使多种凝血因子灭活。掌握“肝素、香豆素、阿司匹林和链激酶”知识点。